口服华法林时INR的值需控制在
A. 0.5～1
B. 1～1.5
C. 1.5～2
D. 2～3
E. 3～4

正确答案：D。2～3

解析：INR（国际标准化比值）用凝血活酶所测得的参比血浆与正常血浆的PT比值和所用试剂标出的ISI值计算出INR，使不同的凝血活酶试剂测得的结果具有可比性。INR的值越高，血液凝固所需的时间越长。NR可有效监测使用抗凝药物的效果。健康成年人，INR值大约1.0。当INR值高于4.0时，提示血液凝固需要很长时间，这可能引起无法控制的出血，甚至死亡。而INR低于2.0不能提供有效的抗凝。口服华法林时INR的值需控制在2-3（ D对）。